关于特发性早熟，最主要特点是
A. 性发育过程遵循正常规律
B. 影响最终身高
C. 生长速度加快
D. 骨龄增速
E. 骨髓早愈合

正确答案：A。性发育过程遵循正常规律

解析：特发性早熟属于中枢性早熟的特殊类型，但其特点于中枢性早熟类似，最主要的特点就是性发育过程遵循正常规律（A对），但由于过早发育，将引起患儿近期蹿长，骨骼生长加速，骨龄提前，骨骺可提前融合，影响终身高（BCDE错）。